产褥妇，现产后3天，出现急性腹痛伴发热2天，腹部包块增大，曾诊断患“子宫肌瘤”。本例应考虑的诊断是
A. 产褥感染
B. 子宫肌瘤囊性变
C. 子宫肌瘤玻璃样变
D. 子宫肌瘤红色变
E. 子宫肌瘤恶性变

正确答案：D。子宫肌瘤红色变

解析：该患者为产褥妇（子宫肌瘤红色样变易发期），有子宫肌瘤病史，产后3天(处于产褥期）出现急性腹痛伴发热，肌瘤包块增大（可有剧烈腹痛伴恶心、呕吐、发热，白细胞计数升高，检查发现肌瘤迅速增大、压痛），应考虑诊断为子宫肌瘤红色变（D对）。产褥感染（P226）（A错）指分娩及产褥期生殖道受病原体侵袭，引起局部或全身感染，表现为发热、疼痛、异常恶露三大症状。子宫肌瘤玻璃样变（P311）（C错）是子宫肌瘤变性中最常见的类型；后继续发展为子宫肌瘤囊性变（P311）（B错），表现为肌细胞坏死液化发生囊性变，此时子宫肌瘤变软，两者均无剧烈腹痛伴发热的表现无剧烈腹痛、呕吐、发热，白细胞计数升高，妇检肌瘤迅速增大、压痛等症状。子宫肌瘤恶性变（P311）（E错）少见，多见于绝经后伴疼痛和出血的患者。